患者，男，40岁，病发于夏季，小便艰涩疼痛，尿道窘迫，曾排尿中断，腰腹绞痛难忍，舌红苔黄腻，脉弦数。应首先考虑的是
A. 膏淋
B. 石淋
C. 热淋
D. 劳淋
E. 气淋

正确答案：B。石淋

解析：小便艰涩疼痛，为淋证；排尿中断，腰腹绞痛难忍，为湿热下注，煎熬尿液，结为砂石，阻滞尿道的特点，为石淋主症（B对）。膏淋（A错）为小便混浊如米泔或滑腻如膏脂。热淋（C错）起病急伴发热，小便赤，尿灼痛。劳淋（D错）日久，遇劳即发。气淋（E错）小腹胀满明显。